下列哪个药物不宜做肌内注射
A. 肾上腺素
B. 去甲肾上腺素
C. 异丙肾上腺素
D. 间羟胺
E. 麻黄碱

正确答案：B。去甲肾上腺素